夏季在住宅群建筑区使建筑物长轴与主导风向形成多少度角时，在相同间距情况下，更有利于下风侧各排房屋的通风
A. 30°
B. 45°
C. 60°
D. 90°
E. ＜30°

正确答案：C。60°

解析：本题考查利于通风的角度。夏季在住宅群建筑区使建筑物长轴与主导风向形成60°角（C对ABDE错）时，在相同间距情况下，更有利于下风侧各排房屋的通风。